马钱子的功效是
A. 祛风止痛
B. 破气止痛
C. 软坚散结
D. 化瘀散结
E. 消肿散结

正确答案：E。消肿散结

解析：本题考查的是马钱子的功效。马钱子的功效是消肿散结（E对）。马钱子：【功效】散结消肿，通络止痛。露蜂房：【功效】攻毒杀虫，祛风止痛（A错）。青皮：【功效】疏肝破气，消积化滞。青皮质重沉降下行而力猛，作用偏于中下二焦，主疏肝破气，又善散结止痛（B错），治肝郁胸胁胀痛、乳房胀痛或结块、乳痈、疝气肿痛、癥瘕积聚及久疟癖块。牡蛎：【功效】平肝潜阳，镇惊安神，软坚散结（C错），收敛固涩，制酸止痛。小金丸：【功能】散结消肿，化瘀（D错）止痛。